关于创口愈合的说法，下列说法错误的是
A. 用电刀手术缝合后的切口，早期炎性反应更为明显
B. 激光刀手术缝合后的切口创缘，早期主要表现为凝固性坏死
C. 初期或一期愈合一般在10～20天
D. 拔牙创口的愈合在临床属于二期或延期愈合
E. 二期或延期愈合的创口形成明显的瘢痕

正确答案：C。初期或一期愈合一般在10～20天

解析：用电刀手术缝合后的切口，早期炎性反应更为明显，切口在第7天出现组织学上的初步愈合，而激光刀手术缝合后的切口创缘，早期主要表现为凝固性坏死，切口在术后第10天才有组织学上的愈合。缝合的创口，一般在7～10天内全部愈合者，称为初期或一期愈合。未经缝合的创口，其愈合往往经过肉芽组织增生，再为周围上皮爬行覆盖的过程，在临床上称为二期或延期愈合（拔牙创口的愈合即属此类）。这种创口愈合后结缔组织多，在软组织部位，形成明显的瘢痕。掌握“口外创口处理”知识点。